根据流行病学调查，新生儿唇腭裂的患病率大约为
A. 0.6:1000
B. 1.6:1000
C. 2.6:1000
D. 1.0:1000
E. 2.0:1000

正确答案：D。1.0:1000

解析：本题考查腭裂。唇裂是口腔颌面部最常见的先天性畸形，常与腭裂伴发。根据流行病学调查，新生儿唇腭裂的患病率大约为1:1000（D对）。